生产过程中的生物性有害因素，不包括
A. 森林脑炎病毒
B. 流行性乙脑病毒
C. 炭疽杆菌
D. 布氏杆菌
E. 禽流感病毒

正确答案：B。流行性乙脑病毒

解析：本题考查生产过程中的生物性有害因素。生产原料和作业环境中存在的致病微生物或寄生虫，如炭疽杆菌（C对）、真菌孢子（吸入霉变草粉尘所致的外源性过敏性肺泡炎）、森林脑炎病毒（A对），以及生物病原物均属于生产过程中的生物性有害因素。由牛羊传染的布氏杆菌（D对）和由禽类传染的禽流感（E对），属于生物病原物，均是畜牧业工作人员从事生产过程中常见的疾病。流行性乙脑病毒（B错，为本题正确答案）是虫媒传播的病毒，有一定季节性，与生产过程没有明确的关系，不属于生产过程中的生物性有害因素。